18岁女孩，2小时前左下腹部剧烈疼痛，恶心呕吐2次，体温37.5℃。肛查子宫右侧触及活动良好触痛明显手拳大肿物。本例应采取的处理措施是
A. 给予抗生素、止痛药，观察病情进展
B. 抗结核药物治疗
C. 进行腹部穿刺明确诊断
D. 进行腹腔镜检查明确诊断
E. 行剖腹探查

正确答案：E。行剖腹探查

解析：该患者2小时前左下腹部剧烈疼痛，伴恶心、呕吐，体温37.5℃（蒂扭转的典型症状是体位改变后突然发生一侧下腹剧痛，常伴恶心、呕吐甚至休克）。肛查：子宫右侧触及活动良好触痛明显手拳大肿物，最可能的诊断是卵巢肿瘤蒂扭转。卵巢肿瘤蒂扭转的治疗原则是一经确诊，尽快行剖腹手术（八年制第2版妇产科学）（E对），而不是进行腹腔镜检查明确诊断（D错）。给予抗生素止痛药，观察病情进展（A错）、抗结核药物治疗（B错）、进行腹部穿刺明确诊断（C错）均与治疗原则不相符，反而耽误最佳手术时机，甚至危及患者生命。